化妆品安全性评价是在
A. 化妆品生产以前对其原料或成品进行安全性评价
B. 化妆品生产之后对其原料或成品进行安全性评价
C. 化妆品生产之前或销售之后对其原料或成品进行安全性评价
D. 化妆品生产之前或销售之前对其原料或成品进行安全性评价
E. 化妆品生产中间对其原料或成品进行安全性评价

正确答案：D。化妆品生产之前或销售之前对其原料或成品进行安全性评价